完带汤的组成含有
A. 白术，山药，人参，五味子
B. 白术，陈皮，党参，白芍
C. 白术，莲子肉，人参，苍术
D. 白术，山药，山茱萸，苍术
E. 白术，龙眼肉，人参，苍术

正确答案：B。白术，陈皮，党参，白芍

解析：完带汤组成药物有：白术、苍术、陈皮、党参、白芍、柴胡、淮山药、芥穗、甘草（B对）。